最常见的一种妄想是
A. 关系妄想
B. 被控制妄想
C. 夸大妄想
D. 被害妄想
E. 嫉妒妄想

正确答案：D。被害妄想